碘的最好的食物来源是
A. 蔬菜、水果
B. 牛奶
C. 肉类
D. 蛋类
E. 海产品

正确答案：E。海产品